某医师拟比较四组人群血型分布（A、B、AB和O型）的差别，适宜的统计分析方法为
A. u检验
B. 回归分析
C. 秩和检验
D. t检验
E. 卡方检验

正确答案：E。卡方检验

解析：本题是比较四组人群4种血型的分布是否有差别，即比较四组人群血型的构成比有无差别，应选用4×4列联表资料的卡方（χ²）检验（E对）。t（A错）检验是用于计量资料两组均数比较的检验方法。μ（B错）检验是在大样本（n＞30）的情况下，检验随机变量的数学期望是否等于某一已知值的一种假设检验方法。回归分析（B错）是确定两种或两种以上变量间相互依赖的定量关系的一种统计分析方法。秩和检验（C错）是一种非参数检验方法，当数据不满足参数检验的条件时使用的一种分析方法。